中暑
A. 调节性体温升高
B. 被动性体温升高
C. 两者均可
D. 两者均无
E. 无

正确答案：B。被动性体温升高

解析：体温升高分为生理性体温升高（月经前期、剧烈运动、应激等）和病理性体温升高（发热和过热）。中暑是由于环境高温使机体散热障碍，体温调节中枢不能将体温控制在与调定点相适应的水平上，引起被动性体温升高（即过热），属于病理性体温升高（B对）。